颈部手术缝合最宜的针距是
A. 1～2mm
B. 2～3mm
C. 3～5mm
D. 5mm
E. 5～8mm

正确答案：D。5mm

解析：一般整复手术以缝合边距2～3mm、针距3～5mm，颈部手术缝合边距3mm、针距5mm为宜，而组织极易撕裂的舌组织缝合时边距和针距均应增至5mm以上。掌握“口外手术组织切开、止血及组织分离”知识点。